关于细颗粒物的说法中，不正确的是
A. 易沉积于肺泡中
B. 又称为飘尘
C. 其某些较细组分甚至可穿透肺泡进入血液
D. 其空气动力学直径≤2.5μm
E. 易于吸附各种重金属元素

正确答案：B。又称为飘尘

解析：本题考查细颗粒物。细颗粒物是指空气动力学直径≤2.5μm（D对）的细颗粒。它在空气中悬浮的时间更长，易于滞留在终末细支气管和肺泡中（A对），其中某些较细的组分还可穿透肺泡进入血液（C对）。PM₂.₅更易于吸附各种有毒的有机物和重金属元素（E对），对健康的危害极大。飘尘（B错，为本题正确答案）是可吸入颗粒物的别称。